用药物可能治愈的先天性心脏病是
A. 法洛四联症
B. 动脉导管未闭
C. 房间隔缺损
D. 室间隔缺损
E. 大血管部分转位

正确答案：B。动脉导管未闭

解析：大多数先天性心脏病无法药物治愈，但动脉导管未闭出生在1周以内使用吲哚美辛可使90%患儿痊愈（B对）。法洛四联症（A错）、房间隔缺损（C错）、室间隔缺损（D错）、大血管部分转位（E错）的治愈必需采取手术的方法。